辅酶含有维生素PP的是
A. FAD
B. NADP⁺
C. CoQ
D. FMN
E. FH₄

正确答案：B。NADP⁺